可由较轻外力，如在进食时骤然咀嚼硬物所致的牙周膜的轻度损伤称为
A. 牙震荡
B. 冠折
C. 根折
D. 牙脱位
E. 冠根联合折

正确答案：A。牙震荡

解析：牙震荡是指牙外伤时，牙周膜的轻度损伤称为牙震荡，可由较轻外力，如在进食时骤然咀嚼硬物所致。掌握“牙震荡”知识点。